制备嵌体窝洞时，与修复体边缘封闭直接相关的是
A. 洞斜面
B. 边缘嵴
C. 轴面角
D. 洞的线角
E. 洞的深度

正确答案：A。洞斜面

解析：嵌体修复时需要做洞缘斜面。掌握“金属嵌体”知识点。